《素问·水热穴论》中所称的“胃之关”为
A. 肝
B. 心
C. 脾
D. 肺
E. 肾

正确答案：E。肾

解析：津液代谢过程中，各脏腑形体官窍代谢后产生的浊液，以及胃肠道中的部分津液，通过三焦水道下输于膀胱，在肾气的蒸化作用下，其清者经脾达肺，重新参与津液代谢；浊者留而为尿，经过肾气蒸化与固摄作用的协调，正常的排出。若肾气衰弱，气化功能失常，则开合不利，胃若再照常受纳，势必会因为水液过剩而导致胃脘鼓胀，肌肤水肿，小便不利之疾患。故称肾者，胃之关（E对）。